化学毒物在体内的吸收、分布和排泄过程称
A. 生物转化
B. 生物转运
C. ADME过程
D. 消除

正确答案：B。生物转运

解析：本题考查生物转运。机体对于化学毒物的处置包括吸收、分布、代谢和排泄四个过程（又称ADME过程）（C错）。其中化学毒物在体的吸收、分布和排泄过程称为生物转运（B对D错）；代谢过程称为生物转化（A错）。